抗结核作用强，且对金葡菌有效的药物是
A. 利福平
B. 对氨基水杨酸
C. 吡嗪酰胺
D. 链霉素
E. 乙胺丁醇

正确答案：A。利福平

解析：利福平与其他抗结核药联合使用可治疗各种类型的结核病，包括初治及复发患者。也可治疗麻风病和耐药金葡菌及其他敏感细菌所致感染和重症胆道感染。此外，利福平局部用药可用于沙眼、急性结膜炎及病毒性角膜炎的治疗。掌握“异烟肼、利福平及乙胺丁醇”知识点。